有神经衰弱综合征和造血系统异常的职业中毒最可能是
A. 慢性汞中毒
B. 慢性铅中毒
C. 慢性苯中毒
D. 慢性砷中毒
E. 慢性锰中毒

正确答案：C。慢性苯中毒